属于盆底内层（即盆膈）肌肉的是
A. 球海绵体肌
B. 会阴深横肌
C. 肛提肌
D. 坐骨海绵体肌
E. 肛门外括约肌

正确答案：C。肛提肌

解析：盆底内层为盆膈是骨盆底最坚韧的一层，由肛提肌（C对）及其内外面各覆一层筋膜组成。盆底外层由会阴浅筋膜及其深面的3对肌肉及一括约肌组成，即球海绵体肌（A错）、坐骨海绵体肌（D错）、会阴浅横肌和肛门外括约肌（E错）。骨盆底中层为泌尿生殖膈，由上、下两层坚韧的筋膜及其间的一对会阴深横肌（B错）及尿道括约肌组成。